关于Bednar溃疡发病位置描述正确的是
A. 上颌软硬腭交汇处
B. 双侧上腭翼钩处
C. 舌腹、舌尖、舌侧缘
D. 舌侧缘、舌系带、舌根
E. 上下颌牙槽嵴顶及对应口腔前庭区

正确答案：B。双侧上腭翼钩处

解析：本题考查Bednar溃疡临床表现。Bednar溃疡发病位置描述正确的是双侧上腭翼钩处（B对）。贝氏溃疡（Bednar ulcer）指由婴儿吮吸拇指或过硬的橡皮奶头引起。固定发生于硬腭、双侧翼钩处黏膜表面。Bednar溃疡一般不会发生于上颌软硬腭交汇处（A错），舌腹、舌尖、舌侧缘（C错），舌系带、舌根（D错），上下颌牙槽嵴顶及对应口腔前庭区（E错）。